据统计某省以往病毒性肝炎发病率维持在0.13%左右，1998年其病的发病率达到0.5%，这种情况属于
A. 散发
B. 暴发
C. 隐性流行
D. 流行
E. 大流行

正确答案：D。流行

解析：本题考查疾病流行。流行（D对ABCE错）是指在某地区某病的发病率显著超过该病历年发病率水平。